符合中度昏迷表现的是
A. 对光反射存在
B. 角膜反射存在
C. 眼球无转动
D. 肌肉松弛
E. 深反射消失

正确答案：C。眼球无转动

解析：中度昏迷病人对外界各种刺激均无反应，对剧烈刺激可产生防御反应。眼球无转动（C对），角膜反射减弱（B错），瞳孔对光反射迟钝（A错）。肌肉松弛（D错）和深反射消失（E错）为深度昏迷的表现（P62）。